缓解哮喘症状的首选药物是
A. 糖皮质激素
B. β2受体激动剂
C. 白三烯调节剂
D. 氨茶碱
E. 抗胆碱药

正确答案：B。β2受体激动剂

解析：哮喘的药物治疗：1.β2受体激动剂是缓解哮喘症状的首选药物（B对）。2.茶碱（黄嘌呤）类药物 如氨茶碱，适合夜间哮喘的治疗（D错），注意静脉注射时应缓慢进行。3.抗胆碱药物  可以阻断节后迷走神经通路，降低迷走神经兴奋性而起到舒张支气管的作用（E错），适用于夜间哮喘及痰多患者。4.糖皮质激素 最强的抗炎剂，目前GINA（全球哮喘防治创议）方案中推荐的一线药物（A错），不仅能有效控制症状，并可作为缓解期的预防用药。5.白三烯调节剂 发挥抗炎作用，同时可舒张支气管平滑肌，可作为控制轻度哮喘的较好选择（C错）。